下列哪项是慢性胃炎最主要的病因
A. 胃酸和胃蛋白酶
B. 非甾体抗炎药
C. 幽门螺杆菌
D. 自身免疫
E. 十二指肠液反流

正确答案：C。幽门螺杆菌

解析：慢性胃炎最主要的病因是幽门螺杆菌（C对）。十二指肠液反流（E错）、自身免疫（D错）、年龄因素和胃粘膜营养因子缺乏也是慢性胃炎的病因。胃酸和胃蛋白酶（A错）因素主要是由于自身免疫抗体的产生导致；非甾体抗炎药（B错）为急性胃炎的病因。